女，35岁。双睑下垂9个月，吞咽困难言语不清3个月。新斯的明试验阳性，胸部CT示胸腺增生。自身抗体在该病病理过程中所识别的抗原是
A. 内啡肽
B. 乙酰胆碱
C. 内啡肽受体
D. 脑啡肽受体
E. 乙酰胆碱受体

正确答案：E。乙酰胆碱受体

解析：患者双睑下垂，吞咽困难言语不清，新斯的明试验阳性，胸部CT示胸腺增生（80%的重症肌无力患者胸腺重量增加）。考虑为MG。在该病病理过程中，自身抗体AChR抗体所识别的抗原是AChR（E对）。